以上疾病中能够观察到明显修复性过程的是
A. 根尖周肉芽肿
B. 根尖周脓肿
C. 致密性骨炎
D. 急性牙髓炎
E. 牙髓坏死

正确答案：C。致密性骨炎

解析：本题考查急慢性根尖周炎。致密性骨炎（C对）能够观察到明显修复性过程。致密性骨炎病损中被吸收破坏的根尖周牙骨质出现修复，甚至过度沉积，出现牙骨质过度增厚。